注射剂质量要求和临床应用注意事项的说法，错误的是
A. 乳状液型注射液不得用于静脉注射
B. 混悬型注射液不得用于静脉注射或椎管内注射
C. 溶液型注射剂应澄清
D. 乳状液型注射液不得有相分离现象
E. 注射液如有抑菌剂，其标签或说明书应标明抑菌剂的种类和浓度

正确答案：A。乳状液型注射液不得用于静脉注射

解析：本题考查注射剂的质量要求。静脉用乳状液型注射液中90%的乳滴粒径应在1㎛以下，不得有大于5㎛的乳滴（A错，为本题正确答案）。溶液型注射剂应澄清（C对）。除另有规定外，混悬型注射液中原料药物粒径应控制在15㎛以下，含15～20㎛（间有个别20～50㎛）者，不应超过10%，若有可见沉淀，振摇时应容易分散均匀。混悬型注射液不得用于静脉注射或椎管内注射（B对）；乳状液型注射液不得有相分离现象（D对），不得用于椎管内注射。除另有规定外，输液应尽可能与血液等渗。注射剂的标签或说明书中应标明其中所用辅料的名称，如有抑菌剂还应标明抑菌剂的种类及浓度（E对）；注射用无菌粉末应标明配制溶液所用的溶剂的种类，必要时还应标注溶液剂量。